患者，男，62岁。外出散步时，突然昏仆不省人事，伴口噤不开，牙关紧闭，肢体强痉，治疗应首选
A. 督脉、任脉经穴
B. 督脉、足太阳经穴
C. 督脉、手厥阴经穴
D. 任脉、手厥阴经穴
E. 任脉、足太阳经穴

正确答案：C。督脉、手厥阴经穴

解析：本题考查常见的病症的辩证、处方。题中患者以突然昏仆不省人事为主症，故诊断为中风中脏腑。伴有口噤不开，牙关紧闭，肢体强痉故辨为闭证，当取手厥阴经及督脉经穴为主穴，以醒脑开窍，启闭固脱（C对）。任脉为“阴脉之海”调节全身阴经脉气（ABDE错）